肝硬化患者，出现肾衰竭，最可能的原因是
A. 脾功能亢进
B. 大量腹水
C. 感染
D. 肝肾综合征
E. 上消化道出血

正确答案：D。肝肾综合征

解析：肝硬化晚期合并顽固腹水时可发生肝肾综合征，其临床特征为自发性少尿或无尿、氮质血症、稀释性低钠血症和低尿钠。此时，肾脏无器质性病变，故亦称为功能性肾衰竭，即肝硬化出现肾衰竭时，原因是出现了肝肾综合征（D对）